乳牙牙根开始吸收的时间是
A. 替牙前1年内
B. 替牙前1～2年
C. 替牙前2～3年
D. 替牙前3～4年
E. 替牙前4～5年

正确答案：D。替牙前3～4年

解析：本题考查恒磨牙髓腔形态及乳恒牙髓腔临床意义。乳牙在替牙前3～4年（D对）牙根即开始吸收，因此在治疗接近替牙期的乳磨牙时，慎勿将吸收穿透的髓室底误认为是根管口，以致损伤根周组织。